女性尿道开口于
A. 尿生殖膈裂孔处
B. 阴道前庭
C. 盆膈裂孔
D. 阴道口与肛门之间
E. 耻骨联合前方

正确答案：B。阴道前庭

解析：女性尿道开口于阴道前庭（B对）的尿道外口，尿道外口位于阴道口的前方、阴蒂的后方。